《中小学校建筑设计规范》要求，中、小学黑板的长度分别不应小于
A. 中学3.0m；小学3.5m
B. 中学3.2m；小学3.5m
C. 中学3.5m；小学4.0m
D. 中学4.0m；小学3.6m
E. 中学4.0m；小学4.5m

正确答案：D。中学4.0m；小学3.6m